行于下肢外侧中线的经脉是
A. 足少阴肾经
B. 足厥阴肝经
C. 足阳明胃经
D. 足太阴脾经
E. 足少阳胆经

正确答案：E。足少阳胆经

解析：本题考查十二经脉在四肢的分布，属于理解记忆内容。下肢外侧为阳明在前，少阳在中，太阳在后（Ｄ对，ABCE错）。